关于牙体缺损的描述，错误的是
A. 影响咀嚼、发音和美观
B. 牙体硬组织外形和结构缺损
C. 造成牙形态、颜色和数目异常
D. 影响牙髓、牙周组织健康
E. 影响牙邻接和咬合

正确答案：C。造成牙形态、颜色和数目异常

解析：本题考查牙体缺损。关于牙体缺损的描述，错误的是造成牙形态、颜色和数目异常（C错，为本题的正确答案）。牙体缺损是指牙体硬组织不同程度的外形和结构的破坏、缺损或发育畸形，造成牙体形态、咬合和邻接关系的异常，影响牙髓和牙周组织甚至全身的健康，对咀嚼、发音和美观等也将产生不同程度的影响。综上所述，影响咀嚼、发音和美观（A对）；牙体硬组织外形和结构缺损（B对）；影响牙髓、牙周组织健康（D对）；影响牙邻接和咬合（E对）均是对牙体缺损的正确描述。